血枯瘀阻型带下过少治疗选方
A. 桃红四物汤
B. 左归丸
C. 小营煎
D. 少腹逐瘀汤
E. 八珍汤

正确答案：C。小营煎

解析：血枯瘀阻型带下过少机理：素体脾胃虚弱，化源不足，堕胎多产，大病久病等均可导致经亏血枯，瘀血内停，瘀阻血脉，精血不足且不循常道，阴津不得润养胞宫、阴道，发为带下过少。治法：补血益精，活血化瘀，用小营煎养血滋阴（C对）。桃红四物汤主治血虚兼血瘀证（A错）。肝肾亏损型带下过少用左归丸（B错）。痛经寒凝血瘀证用少腹逐瘀汤（D错）。八珍汤益气补血，主治气血两虚（E错）。